外源性化学物引起有害作用的靶器官是指外源性化学物
A. 直接发挥毒作用的部位
B. 最早达到最高浓度的部位
C. 在体内浓度最高的部位
D. 表现有害作用的部位
E. 代谢活跃的部位

正确答案：A。直接发挥毒作用的部位